围绝经期保健正确的是
A. 不需避孕
B. 不会有肿瘤的发生
C. 不用激素替代以防乳腺癌的发生
D. 不需定期体检
E. 补充钙剂，预防骨质疏松

正确答案：E。补充钙剂，预防骨质疏松

解析：本题考查围绝经期的保健。绝经后骨质吸收速度快于骨质生成，围绝经期约25%妇女患有骨质疏松症，严重者易骨折，多发生于桡骨远端、股骨颈、椎体等部位，因此在为围绝经期应补充钙剂，预防骨质疏松（E对ABCD错）。